Rv5+Svl>4.0mV，可诊断为
A. 左室高电压
B. 左室劳损
C. 右室肥大
D. 双室肥大
E. 左室肥大劳损

正确答案：A。左室高电压